隙卡沟应预备成沟底稍平，底边呈圆形。这是为了
A. 有利于隙卡制作
B. 防止隙卡折断
C. 少磨牙
D. 以免相邻两牙遭受侧向挤压力
E. 有利义齿稳定

正确答案：D。以免相邻两牙遭受侧向挤压力

解析：本题考查隙卡沟的预备。隙卡沟指通过基牙与其相邻（牙合）面的（牙合）外展隙区的部分，隙卡通过外展隙时应不妨碍（牙合）接触。隙卡沟应预备成沟底稍平，底边呈圆形而不是楔形，以免使相邻两牙遭受侧向挤压力（D对）而移位。颊舌外展处的转角处磨圆有利于隙卡制作（A错）。防止隙卡折断（B错）、少磨牙（C错）以及有利义齿稳定（E错）是制作卡环时应考虑的因素，但不是隙卡沟预备成沟底稍平，底边呈圆形的原因或目的。